对鉴别急性支气管炎与流行性感冒最有意义的是
A. 白细胞计数
B. 咳嗽、咯痰
C. 肺部啰音
D. X线检查
E. 流行病学、病毒分离和血清学检查

正确答案：E。流行病学、病毒分离和血清学检查

解析：急性支气管炎与流行性感冒均有咳嗽、咳痰（B错），白细胞计数增高（A错），肺部干、湿啰音（C错）及X线显示肺纹理增多（D错）的表现。但对于有流行性感冒史、分泌物及血清学检查出流行病病毒者（E对）可诊断为流行性感冒，可用于与急性支气管炎的鉴别。